男性，55岁。肝硬化8年，查体有少量腹水，如患者应用利尿剂，首选的是
A. 甘露醇
B. 螺内酯（安体舒通）
C. 乙酰唑胺
D. 氢氯噻嗪（双氢克尿噻）
E. 速尿

正确答案：B。螺内酯（安体舒通）

解析：肝硬化时，肝脏对醛固酮的灭活作用减弱，醛固酮增多，导致水钠潴留。螺内酯（B对）可竞争性结合醛固酮受体，抑制醛固酮的作用，故肝硬化腹水首选螺内酯治疗。甘露醇（A错）为渗透性利尿剂，多用于脑水肿患者。乙酰唑胺（C错）、氢氯噻嗪（D错）、速尿（E错）均为利尿剂，仅能通过利尿改善水肿，没有拮抗醛固酮的作用。